母乳喂养好处不包括
A. 增加母婴感情
B. 促进子宫复旧
C. 避孕
D. 提高婴儿免疫力
E. 预防产后出血

正确答案：C。避孕

解析：母乳喂养好处包括增加母婴感情（A对）、促进子宫复旧（B对）、提高婴儿免疫力（D对）、预防产后出血（E对）和减少再受孕的机会，而非避孕（C错，为本题正确答案）。